关于灭菌参数F₀值的说法正确的
A. 指在一定灭菌温度下被灭菌物品中微生物降低10%所需时间
B. 指在一定灭菌温度下被灭菌物品中微生物提高10%所需时间
C. 指与121度热压灭菌杀灭物品中全部微生物相当的时间
D. 指Z值为10度时一定灭菌温度与105度产生相同灭菌效果的时间
E. 指Z值为10度时一定灭菌温度与121度产生相同灭菌效果的时间

正确答案：C、E。指与121度热压灭菌杀灭物品中全部微生物相当的时间；指Z值为10度时一定灭菌温度与121度产生相同灭菌效果的时间

解析：本题考查F₀值的概念。关于灭菌参数F₀值的说法正确的指与121度热压灭菌杀灭物品中全部微生物相当的时间（C对）；指Z值为10度时一定灭菌温度与121度产生相同灭菌效果的时间（E对）。F₀值在湿热灭菌时，参比温度定为121℃，以嗜热脂肪芽孢杆菌作为微生物指示菌，该菌在121℃时，Z值为10℃。F₀值也可认为是相当于121℃热压灭菌时杀死容器中全部微生物所需要的时间。F₀值为一定灭菌温度（T），Z为10℃所产生的灭菌效果与121℃，Z值为10℃所产生的灭菌效力相同时所相当的时间（min）。